可导致流行性角结膜炎的病原体是
A. 腺病毒
B. 新型肠道病毒71型
C. 埃可病毒
D. 轮状病毒
E. 脊髓灰质炎病毒

正确答案：A。腺病毒

解析：腺病毒是流行性角结膜炎的病原体（A对）。导致手足口的病原体是新型肠道病毒71型（B错）。埃可病毒（C错）和轮状病毒（D错）是小儿腹泻常见的病原体。脊髓灰质炎病毒是脊髓灰质炎的病原体（E错）。